按照中医常用治法理论透达膜原属于
A. 温法
B. 清法
C. 补法
D. 和法
E. 消法

正确答案：D。和法

解析：本题考查和法的概念。按照中医常用治法理论透达膜原属于和法（D对）。和法，又称“和解法”，是通过调和、和解的方法，使半表半里之邪，或脏腑、阴阳、表里失和之证得以解除的治法。温法（A错），又称“温里法”，是使用温热药治疗寒证的治法。温里法适用于里寒证。由于里寒证病情的不同，温里法又分为温中祛寒法、回阳救逆法、温经散寒法三种。清法（B错），又称“清热法”，是运用寒凉性质的方药，通过其泻火、解毒、凉血等作用，以解除热邪的治法。清法适用于里热证。由于热邪有虚实、病位及间夹他邪的不同，清热法又分为清热泻火法、清热凉血法、清热燥湿法、清热解毒法、清虚热法等。补法（C错），又称“补益法”，是用补益药物补养人体气血阴阳不足、改善衰弱状态，治疗各种虚证的治法。补法适用于脏腑、气血、阴阳等各种虚证。消法（E错），又称“消导法”，是消散体内有形积滞以祛除病邪的治法。运用范围比较广泛，凡由气、血、痰、湿、食等壅滞而形成的积滞痞块，均可用消法。